洛夏墨迹试验属于
A. 智力测验
B. 人格测验
C. 神经心理测验
D. 诊断测验
E. 评定量表

正确答案：B。人格测验